甲状腺肿物坚硬如石，高低不平，推之不移。属于
A. 失荣
B. 瘿痈
C. 石瘿
D. 肾岩翻花
E. 肉瘿

正确答案：C。石瘿

解析：甲状腺肿物坚硬如石，高低不平，推之不移，符合石瘿的临床特点（C对）。失荣一般表现为颈部淋巴结肿大，生长较快，且肿块表面不平，固定不移（A错）。瘿痈的临床特点为结喉处结块、肿胀、疼痛，伴有发热，起病急骤（B错）。肾岩翻花是指肾岩日久疮面溃破，形如熟透之石榴，皮裂翻开（D错）。肉瘿的临床特点是颈前喉结一侧或两侧结块，柔韧而圆，如肉之团，随吞咽动作而上下移动，发展缓慢（E错）。